镜下见既有肝细胞大片坏死，又有肝细胞结节状再生，病变符合
A. 急性普通型肝炎
B. 慢性持续性肝炎
C. 慢性活动性肝炎
D. 急性重型肝炎
E. 亚急性重型肝炎

正确答案：E。亚急性重型肝炎

解析：亚急性重型肝炎（E对）的病变特点是既有坏死也有再生，即肝细胞的大片坏死和结节状肝细胞的再生。急性普通型肝炎（A错）镜下的病理改变以变性为主，坏死较轻。变性以细胞水肿为主，严重时可出现气球样变，坏死表现为点状坏死。慢性持续性肝炎（B错）的病理改变为点状坏死，肝小叶界板无破坏。慢性活动性肝炎（C错）碎片状坏死和桥接坏死均明显，无明显再生。急性重型肝炎（D错）是起病急，病情重，病程短，出现大片弥漫性坏死，但来不及再生。